某无牙颌患者，上下颌弓位置关系正常，牙槽嵴丰满，下颌43牙槽嵴唇侧有尖锐骨尖，此患者在全口义齿修复前需进行
A. 唇颊沟加深
B. 上颌结节修整
C. 唇系带修整
D. 牙槽骨修整
E. 颊系带修整

正确答案：D。牙槽骨修整

解析：尖锐骨尖应在义齿修复前进行修整，答案为D。掌握“全口义齿口腔检查及修复前准备”知识点。